患者因后牙深龋洞一次垫底银汞充填，术后一直冷热痛2周，复诊时叩（+），去除原充填物，未见穿髓孔，氧化锌丁香油糊剂安抚，仍有冷热刺激痛不缓解，其原因可能为
A. 充填材料选择不当
B. 未调（牙合）
C. 洞形制备不当
D. 诊断失误
E. 腐质未去净

正确答案：D。诊断失误

解析：本题考查充填后疼痛。患者因后牙深龋洞一次垫底银汞充填，术后一直冷热痛2周，复诊时叩（+），去除原充填物，未见穿髓孔，氧化锌丁香油糊剂安抚，仍有冷热刺激痛不缓解，其原因可能为诊断失误（D对）。根据病例描述，患者后牙深龋洞一次垫底银汞充填，术后一直冷热痛2周，可知患者在第一次就诊时就有牙髓激惹症状，考虑当时为可复性牙髓炎，应该进行安抚治疗，但进行了一次垫底银汞充填，故医生第一次治疗时诊断失误；第二次就诊时，叩（+），去除原充填物，未见穿髓孔，氧化锌丁香油糊剂安抚，仍有冷热刺激痛不缓解，可考虑此时患牙已发展为不可复性牙髓炎，应进行牙髓治疗，但进行了安抚治疗，原因为医生对牙髓状况诊断失误。充填材料选择不当，主要表现为充填材料对牙髓的慢性刺激而导致的远期疼痛不适（A错）。未调（牙合）可因充填物过高，咬合时出现早接触而引起咬合痛（B错）。洞形制备不当可导致充填体脱落或折裂，短期内不会出现牙髓炎症状（C错）。腐质未去尽会导致病变继续发展，累及牙髓，出现远期的疼痛（E错）。